下列关于火器伤的特点的描述不正确的是
A. 火药可以造成
B. 炸药可以造成
C. 组织损伤重，范围大
D. 多部位多器官受伤
E. 伤道复杂，不易感染

正确答案：E。伤道复杂，不易感染

解析：火器伤的特点：以火（炸）药为动力发射的武器所造成的机体组织损伤统称火器伤。一般组织损伤重，范围大、多部位多器官受伤，并可形成复杂的伤道，易感染。掌握“火器伤、热烧伤”知识点。